香薷的功效是
A. 发汗解表，和中化湿
B. 发表散寒，行气宽中
C. 祛风散寒，温肺化饮
D. 发表散寒，祛风胜湿
E. 散风寒，通鼻窍

正确答案：A。发汗解表，和中化湿

解析：本题考查的是香薷的功效。香薷的功效是发汗解表，和中化湿（A对）。香薷：【功效】发汗解表，和中化湿，利水消肿。紫苏：【功效】发表散寒，行气宽中（B错），安胎，解鱼蟹毒。细辛：【功效】祛风散寒，通窍，止痛，温肺化饮（C错）。藁本：【功效】发表散寒，祛风胜湿（D错），止痛。辛夷：【功效】散风寒，通鼻窍（E错）。